主吸收水分和排泄糟粕的脏腑是
A. 胃
B. 三焦
C. 脾
D. 大肠
E. 小肠

正确答案：D。大肠

解析：大肠的主要生理功能是主传导糟粕与主津（D对），大肠主传导，又称“传导之官”，指大肠接受由小肠下移的食物残渣，吸收水分，形成糟粕，经肛门排泄粪便的功；大肠主津，指大肠接受食物残渣，吸收水分的功能。由于大肠参与体内的津液代谢，故称"大肠主津"。胃的主要生理功能是主受纳和腐熟水谷（A错）。三焦的主要生理功能是运行津液和通行元气（B错）。人出生后，生命过程的维持及其所需精气血津液等营养物质的生成，均依赖于脾（胃）运化所化生的水谷精微，故称脾（胃）为“后天之本”“气血生化之源”（C错）。小肠的主要生理功能是主受盛化物，泌别清浊，主液（E错）。